慢性肾小球肾炎的基本临床表现不包括
A. 蛋白尿
B. 血尿
C. 少尿
D. 水肿
E. 高血压

正确答案：C。少尿

解析：慢性肾小球肾炎指以蛋白尿、血尿、水肿、高血压为基本临床表现，起病方式不同，病情迁延，缓慢进展，终将发展为慢性肾衰竭的一组疾病。掌握“慢性肾小球肾炎、肾病综合征”知识点。